急性肾炎有轻度水肿时
A. 限制水盐及卧床休息
B. 二氮嗪
C. 速尿
D. 利血平
E. 西地兰

正确答案：A。限制水盐及卧床休息

解析：急性期必须卧床休息2～3 周，待肉眼血尿消失，水肿减退，血压正常后方可下床轻微活动。水肿、高血压者应限盐及限水（A对）。三氯噻嗪为利尿剂，用于各种水肿（以对心脏性水肿疗效较好）、各期高血压及尿崩症（B错）。速尿适用于一、二级高血压，尤其是老年高血压或并发心衰者。临床上用于治疗心脏、肾性水肿，肝硬化腹水、降压等症（C错）。利血平主要用于轻、中度高血压患者（D错）。发生急性心衰时，应纠正心衰，用西地兰快速强心（E错）。